对于具有△12的三萜皂苷，其质谱容易发生
A. α-裂解
B. γ-裂解
C. RDA裂解
D. 苄基裂解
E. 麦氏重排

正确答案：C。RDA裂解